旧的修复体出现破损和裂隙，唾液进入根管系统超过30天，根充质量好，需
A. 重新修复
B. 拔出牙齿
C. 根管再治疗
D. 根尖手术
E. 牙周手术

正确答案：C。根管再治疗

解析：本题考查根管再治疗。旧的修复体出现破损和裂隙，唾液进入根管系统超过30天，尽管原根充质量好，但在重新进行冠修复前需根管再治疗（C对）。